有关三羧酸循环说法正确的是
A. 是糖、脂、蛋白质三大物质最终氧化的共同途径
B. 是糖、脂、氨基酸三大物质最终氧化的共同途径
C. 是糖、氨基酸、蛋白质三大物质最终氧化的共同途径
D. 是脂、氨基酸、蛋白质三大物质最终氧化的共同途径
E. 是糖、能量、蛋白质三大物质最终氧化的共同途径

正确答案：A。是糖、脂、蛋白质三大物质最终氧化的共同途径

解析：三羧酸循环是糖、脂、蛋白质三大物质最终氧化的共同途径；是糖、脂、某些氨基酸代谢联系和互变的枢纽；是体内产生CO2和能量的主要机制之一。掌握“糖分解”知识点。